女性，62岁。诊断胃癌，血压160/100mmHg，中度贫血，消瘦，不是术前准备必要的项目是
A. 纠正贫血
B. 改善营养状态
C. 检测肝功能
D. 血压降至正常
E. 血生化检查

正确答案：D。血压降至正常

解析：本例患者诊断为胃癌，属于择期手术，需要在术前进行充分的准备方可进行手术：患者血压为160/100mmHg，可不用作特殊准备（D错，为本题正确答案）。患者贫血、消瘦，应纠正贫血（A对）、改善营养状态（B对）以提高患者对手术、失血的耐受能力。检测肝功能（C对）、血生化检查（E对）是所有手术患者的必查项目，有助于患者病情及手术耐受能力的评估。